以下既属于第一级预防，也属于第三级预防的是
A. 促进体力活动
B. 环境有害因素的整治
C. 脑卒中病人的功能锻炼
D. 高血压管理
E. 控烟

正确答案：D。高血压管理

解析：促进体力活动、环境有害因素的整治、控烟为一级预防，脑卒中病人的功能锻炼为三级预防，高血压管理既属于第一级预防，也属于第三级预防（D对）。